牙周病维护期应该进行的内容是
A. 长期服用抗生素
B. 有问题出现时才需复查
C. 定期牙周检查及洁治
D. 只针对口腔卫生差的人进行宣教
E. 复查时应每2个月拍X线片

正确答案：C。定期牙周检查及洁治

解析：本题考查牙周病治疗程序的第四阶段-牙周支持治疗。牙周病维护期应该进行的内容是定期牙周检查及洁治（C对）。牙周病维护期即牙周支持治疗阶段，是牙周疗效得以长期保持的先决条件，需要定期复查，不能等到有问题出现时才复查（B错），否则会延误病情。药物治疗是基础治疗阶段的内容，且一般不倡导长期服用抗生素（A错）。口腔健康宣教也是基础治疗阶段的内容，是针对所有人，而不是只针对口腔卫生差的人（D错）。复查时约一年左右摄X线片以便监测和比较牙槽骨的变化制定下一步的治疗计划，2个月拍摄（E错）不能很好的了解牙槽骨的恢复情况。